患者，男，60岁。慢性支气管炎病史20年。近半年活动后心悸，气短。查体：有肺气肿体征，两肺散在干、湿啰音。剑突下可见心尖搏动，肺动脉瓣区第二心音亢进。应首先考虑的是
A. 冠心病
B. 肺心病
C. 风心病
D. 高血压性心脏病
E. 心肌炎

正确答案：B。肺心病

解析：本例患者有慢支病史20年，近半年出现活动后心悸症状，且查体显示该患者有肺气肿体征，肺动脉高压（肺动脉瓣听诊区第二心音亢进），故首先应考虑为肺源性心脏病（B对）。冠心脏病（A错）发作时常有心前区疼痛，没有肺气肿等肺部表现。风湿性心脏病（C错）有风湿病史，或反复的A组乙型溶血性链球菌感染史，患者常有运动后心悸、气短、心前区不适，累及各瓣膜时，心脏听诊可闻及杂音，其中风湿热最易累及二尖瓣，导致二尖瓣炎，可有心尖区高调、收缩期吹风样杂音或短促低调舒张期中期杂音。高血压性心脏病（D错）是由于血压升高，长期压力负荷增高，引起左心室肥厚和扩张，继而出现心功能不全的症状。本例患者无高血压病史，故不考虑为高血压性心脏病。心肌炎（E错）最常见病因是病毒感染，多数患者发病前1～3周有病毒感染前驱症状（如发热、乏力、肌肉酸痛或恶心、呕吐等），随后出现心悸、胸痛、呼吸困难等，临床诊断病毒性心肌炎绝大部分以心律失常为主诉或首见症状。本例患者是20年的慢性肺病史，且无明显感染症状，故E不符。